李某因要报考研究生，欲向单位请假复习，遂找到其中学同学、县医院的执业医师王某，请王某为其开具病假条。王某为李开出了“病毒性心肌炎。全休壹个月”的诊断证明书。对于王某的行为，县卫生局可以给予
A. 吊销其医师执业证书
B. 警告或责令其暂停执业活动三个月至六个月，并接受培训和继续教育
C. 警告或责令其暂停执业活动六月至一年
D. 调离医师岗位
E. 给予行政或纪律处分

正确答案：C。警告或责令其暂停执业活动六月至一年